治血虚证时，常在补血药中配以补气之品的依据是
A. 气能行血
B. 气能摄血
C. 气能生血
D. 血能载气
E. 血为气母

正确答案：C。气能生血

解析：本题考查的是气与血的关系。治血虚证时，常在补血药中配以补气之品的依据是气能生血（C对）。气与血的关系：气与血都是人体生命活动的物质基础，同源于水谷精微，经肺、脾、肾等脏器的功能活动而化生。气属阳，以推动、温煦功能为主；血属阴，以营养、滋润功能为主。气与血之间的关系，概括为气为血之帅，血为气之母。1.气为血之帅：（1）气能生血：是指血的组成及其化生过程，均离不开气和气的运动变化，即气化功能。营气和津液，是血的主要组成部分，来自脾胃所运化的水谷精气。从摄入的饮食物转化成水谷精气，从水谷精气转化成营气和津液，从营气和津液转化成赤色的血，均离不开气的运动变化。另外，精可以转化为血，亦需气的作用，因此说，气能生血。气旺，则化生血的功能亦强；气虚，则化生血的功能亦弱，甚则可导致血虚。故临床治疗血虚病证时，常于补血药中，配以补气药物以提高疗效，就是“气能生血”理论在临床的具体应用。（2）气能行血（A错）：血的循行，有赖于气的推动，即有赖于心气的推动，肺气的宣发布散，肝气的疏泄条达。由此可见，血是在心、肺、肝三脏之气的协同作用下，运行不息，而流布于全身。故临床治疗血行失常的病证时，常分别配合降气、理气或补气等药物。（3）气能摄血（B错）：气对血液的统摄作用，使血液正常循行于脉管之中，而不逸出脉外。如气虚不能统摄血液，则可以导致各种出血病证，称为“气不摄血”。治疗时，必须用补气摄血的方法，以达止血的目的。2.血为气之母（E错）：血为气之母，是指血是气的载体，并给气以充分的营养，概括为血能载气（D错）和血能生气。由于气的活力很强，易于逸脱，所以气必须依附于血和津液，方能存在于体内，气不能离开血液而自行存在。如气失去依附，则浮散无根而发生气脱。因此，血虚者，可以进一步引起气虚；血脱者，气亦随脱。在治疗大出血时，往往采用益气固脱之法，其机制亦在于此。